判断代谢性酸中毒类型的指标是
A. PH
B. AB
C. BE
D. AG
E. PCO₂

正确答案：D。AG

解析：如果AG≥16mmol/L，则判断患者存在高AG代谢性酸中毒（D对）。